男孩4岁，1小时摔倒后右肩部疼痛，查体：头向右侧偏斜，右肩下沉，右侧上肢活动障碍，皮肤出现淤血，Dugas征阴性。最可能诊断是
A. 锁骨骨折
B. 正中神经损伤
C. 桡骨头半脱位
D. 肘关节脱位
E. 肩关节脱位

正确答案：A。锁骨骨折

解析：该患者男，4岁，1小时摔倒后（锁骨骨折的病因）右肩部疼痛，查体：头向右侧偏斜，右肩下沉，右侧上肢活动障碍，皮肤出现淤血，Dugas征阴性（锁骨骨折的表现），结合患者的病因和表现，最可能的诊断是锁骨骨折（A对）。